下述不是鼠疫耶尔森菌特点的是
A. 两端浓染G-短杆菌
B. 不能在人工培养基上生长
C. 致病物质主要是鼠毒素
D. 以鼠蚤为媒介由鼠传染给人
E. 临床类型分腺鼠疫，败血症鼠疫和肺鼠疫等

正确答案：B。不能在人工培养基上生长

解析：鼠疫耶尔森菌属俗称鼠疫杆菌，是鼠疫的病原菌，属于自然疫源性烈性传染病。其在鼠类机体贮存，有鼠蚤叮咬人类而传染导致鼠疫流行，临床常见类型为腺鼠疫、肺鼠疫和败血症型鼠疫。其致病物质为F1抗原、V/W抗原、外膜抗原及鼠毒素四种。掌握“动物源性细菌”知识点。